服用哌唑嗪可能引起
A. 心动过缓
B. 血钾降低
C. 血钾升高
D. 面部潮红
E. 下肢浮肿

正确答案：E。下肢浮肿

解析：本题考查药物的不良反应。服用哌唑嗪可能引起下肢浮肿（E对）。哌唑嗪首次应用时出现“首剂现象”；严重的体位性低血压。心功能不全者会因钠潴留伴水肿而致体重增加即发生下肢浮肿。
心动过缓（A错）是利血平的不良反应。血钾降低（B错）是呋塞米的不良反应。血钾升高（C错）是ACEI类药物的不良反应。面部潮红（D错）是二氢吡啶类钙通道阻滞剂的不良反应。